脑栓塞的常见表现
A. 眩晕、频繁呕吐、头痛、病变侧共济失调
B. 意识丧失，双侧针尖样瞳孔、四肢瘫痪
C. 突发剧烈头痛、呕吐、脑膜刺激征，右侧偏瘫
D. 安静时发生偏瘫、偏身感觉障碍、瘫痪，无意识障碍
E. 活动中急骤发生瘫痪、偏身感觉障碍，伴短暂意识障碍

正确答案：E。活动中急骤发生瘫痪、偏身感觉障碍，伴短暂意识障碍

解析：脑栓塞是指各种栓子随血流进入颅内动脉使血管腔急性闭塞或严重狭窄，引起相应供血区脑组织发生缺血坏死及功能障碍的一组临床综合征。常见表现为活动中急骤发生瘫痪、偏身感觉障碍，伴短暂意识障碍（E对）。眩晕频繁呕吐头痛病变侧共济失调（A错）主要见于小脑出血（P190）。意识丧失，双侧针尖样瞳孔，四肢瘫痪（B错）主要见于脑室出血（P190）。突发剧烈头痛呕吐脑膜刺激征，右侧偏瘫（C错）见于蛛网膜下腔出血（P194）。安静时发生偏瘫偏身感觉障碍瘫痪，无意识障碍（D错）见于腔隙性脑梗死（P186）。